下列用来维持细胞内外离子浓度的是
A. 钠钾泵
B. K⁺外流
C. Na⁺内流
D. H⁺外流
E. Cl⁻内流

正确答案：A。钠钾泵

解析：钠钾泵也简称钠泵，因其具有ATP酶的活性，故也称Na⁺-K+-ATP酶。钠泵每分解1分子ATP可将3个Na⁺移出胞外，同时将2个K+移入胞内，每个转运周期约需10ms。由于钠泵的活动，可使细胞内的K+浓度约为细胞外液中的30倍，而细胞外液中的Na⁺浓度约为胞质内的10倍。当细胞内的Na⁺浓度升高或细胞外的K+浓度升高时，都可使钠泵激活，以维持细胞内外的Na⁺、K+浓度梯度。故用来维持细胞内外离子浓度的是钠钾泵（A对）。